临床医学研究中的人体试验的审查
A. 要在开始之前提交伦理委员会
B. 要在进行中提交伦理委员会
C. 要在临近结束时提交伦理委员会
D. 要在完成之后提交伦理委员会
E. 无须提交伦理委员会

正确答案：A。要在开始之前提交伦理委员会